突变发生在生殖细胞，结局不包括
A. 畸形
B. 早产
C. 肿瘤
D. 遗传性疾病

正确答案：C。肿瘤

解析：本题考查生殖细胞突变的结局。突变发生在生殖细胞，结局包括畸形（A对）、早产（B对）、遗传性疾病（D对）等。肿瘤（C错，为本题正确答案）属于体细胞突变的结局。